男，32岁，发现血压增高3年。近1年血压持续为170～200/130～140mmHg，近1周头痛视力模糊。眼底检查发现视乳头水肿，最可能的诊断为
A. 急性视乳头病变
B. 脑出血
C. 恶性高血压
D. 脑梗死
E. 高血压脑病

正确答案：C。恶性高血压

解析：恶性高血压也称急进性高血压，起病较急骤，典型表现为血压显著升高，舒张压多持续在130～140mmHg或更高，并有头痛，视力模糊和视盘水肿等症状，且多在中青年发病。结合患者病史和临床表现，本例最可能的诊断为恶性高血压（C对）。急性视乳头病变（A错）仅为病人部分临床表现，不能解释血压持续升高的原因。脑出血（B错）和脑梗死（D错）为高血压常见的脑血管并发症，常见于中老年高血压患者，且多表现为突然剧烈疼痛、呕吐、偏瘫伴血压增高。高血压脑病（E错）属于高血压急症的一种，主要表现为头痛、抽搐和意识障碍，并可伴有短暂的局灶性神经功能缺失（实用内科学第14版P2735），与本例不符。